石斛除养胃生津外，又能
A. 滋阴除热
B. 补脾益气
C. 凉血止血
D. 清心安神
E. 清肝明目

正确答案：A。滋阴除热

解析：本题考查石斛的功效。石斛除养胃生津外，又能滋阴除热（A对）。石斛【功效】养胃生津，滋阴除热，明目，强腰。黄精【功效】滋阴润肺，补脾益气（B错）。小蓟【功效】凉血止血（C错），散瘀消痈。百合【功效】养阴润肺，清心安神（D错）。石决明【功效】平肝潜阳，清肝明目（E错）。